下列哪项能够正确地判定受试者有病与无病的能力
A. 广度
B. 可信度
C. 偏离度
D. 阈值
E. 效度

正确答案：E。效度

解析：真实性也称效度或准确性，是指测量值与实际值（金标准的测量值）符合的程度，即正确地判定受试者有病与无病的能力。掌握“流行病的诊断和筛检试验及疾病监测”知识点。